具有加强十二经脉相为表里两经在体表联系的是
A. 皮部
B. 经筋
C. 经别
D. 别络
E. 奇经

正确答案：D。别络

解析：通过阴经别络走向阳经，阳经别络走向阴经的途径，沟通和加强了为表里的两条经脉之间在肢体的联系，并能通达某些正经所没有到达的部位，可补正经之不足（D对）。